女，72岁。腹痛6小时。进食油腻食物后突发腹痛，以中上腹部为剧。查体：P110次/分，BP110/60mmHg。右上腹部可触及表面光滑包块，有压痛。首选的检查是
A. 逆行胰胆管造影
B. 腹部B超
C. 上消化道X线钡剂造影
D. 腹部X线平片
E. 胃镜

正确答案：B。腹部B超

解析：患者老年女性，腹痛6小时。进食油腻食物后突发腹痛（油腻食物为诱因），以中上腹部为剧。查体见P110次/分（脉率增快，正常值60～100次/分）。右上腹部可触及表面光滑包块，有压痛。根据患者临床表现、体格检查，怀疑为急性胆囊炎，腹部B超（B对）对于空腔脏器诊断效果良好，用于急性胆囊炎的诊断。逆行胰胆管造影（ERCP）（A错）用于观察十二指肠、乳头部病变及胆道系统和胰腺胆管的解剖和病变，可诱发急性胰腺炎和胆管炎，诊断性ERCP不常用（P434）。上消化道钡剂造影（C错）用于诊断上消化道黏膜皱襞的形态与缺损。腹部X线平片（D错）对于鉴别胆道和其他腹内脏器疾病有一定意义，但单纯腹部X线平片对胆道疾病的诊断价值有限。胃镜（E错）用于直接观察胃黏膜病变的部位和范围，并可以钳取组织进行病理检查，仅针对于胃内病变（P348）。